因口服吸收差，可与氨苄西林以1：1的形式以次甲基相连，得到舒它西林的药物是
A. 丙磺舒
B. 克拉维酸
C. 舒巴坦钠
D. 他唑巴坦
E. 甲氧苄啶

正确答案：C。舒巴坦钠

解析：本题考查舒巴坦钠。舒巴坦钠（C对）可与氨苄西林以1：1的形式以次甲基相连得到舒它西林。舒它西林服后可迅速吸收，在体内非特定酯酶的作用下使其水解，释放出较高血清浓度的氨苄西林和舒巴坦，极大改善了舒巴坦钠口服吸收差的特点。丙磺舒（A错）是治疗痛风关节炎类药物。克拉维酸（B错）与阿莫西林组成复方制剂，增加对酶的稳定性。他唑巴坦（D错）是舒巴坦的衍生物。甲氧苄啶（E错）是抗菌增效剂，与磺胺类药物合用，发挥协同作用。